一个女病人畸胎瘤治好了之后，病房里的人不跟她玩排挤她，心理医生帮助她走出来。满足了她的
A. 归属与爱
B. 生理需要
C. 自我需要
D. 尊重需要
E. 待回忆

正确答案：D。尊重需要

解析：本题考查病人心理。一个女病人畸胎瘤治好了之后，病房里的人不跟她玩排挤她，心理医生帮助她走出来。满足了她的尊重需要（D对）。病人常感到成为别人的负担或累赘，自信心降低，因而对尊重的需要会比患病钱更强。病人需要得到人格的尊重，需要保密隐私；另外，向病人提供与疾病有关的诊治信息及病人的知情同意，也体现了对病人的尊重。